最有助于诊断主动脉瓣关闭不全的体征是
A. Graham-Steell杂音
B. 心尖抬举样搏动
C. 心界呈靴形
D. 脉压增加
E. 胸骨左缘第3 肋间舒张期杂音

正确答案：E。胸骨左缘第3 肋间舒张期杂音

解析：主动脉瓣闭关不全时，可在主动脉瓣区，即胸骨左缘第3肋间（E对）闻及舒张期杂音。Graham-Steell杂音（A错）见于二尖瓣狭窄所致的严重肺动脉高压时。心尖抬举样搏动（B错）可见于二尖瓣关闭不全、主动脉狭窄、主动脉关闭不全。心界呈靴形（C错）常见于主动脉关闭不全，也可见于主动脉瓣狭窄、高血压性心脏病、法洛四联症。脉压增加（D错）除了可见于主动脉瓣关闭不全，也可见于主动脉硬化、甲状腺机能亢进、严重贫血、风湿性心脏病、梅毒性心脏病、部分先天性心脏病与高血压心脏病、细菌性心内膜炎等。